以下哪项又称为终末导管癌，小叶癌
A. 圆柱瘤
B. 多形性腺瘤癌变
C. 腺淋巴瘤
D. 淋巴乳头状囊腺瘤
E. 多形性低度恶性腺癌

正确答案：E。多形性低度恶性腺癌

解析：多形性低度恶性腺癌又称为终末导管癌，小叶癌。掌握“多形性低度恶性腺癌”知识点。